提示疾病发展转折点的是
A. 自汗
B. 盗汗
C. 蒸汗
D. 冷汗
E. 战汗

正确答案：E。战汗

解析：战汗，表现为患者先恶寒战栗而后汗出的症状。因邪盛正衰，邪伏不去，一旦正气来复，正邪剧争，就可出现战汗。常见于外感热病或伤寒邪正剧烈斗争的阶段，是疾病发展的转折点。若汗出热退，脉静身凉，提示邪去正复，疾病向愈；若汗出而身热不退，烦躁不安，脉来急疾，提示邪盛正衰，病情恶化（E对）。自汗多见于气虚证和阳虚证（A错）。盗汗多见于阴虚证（B错）。